双胍类降血糖药物的降糖作用机制为
A. 促进餐后胰岛素的分泌
B. 促进基础胰岛素的分泌
C. 增加机体对胰岛素的敏感性
D. 激活过氧化物酶增殖体活化因子受体
E. 增加外周组织对葡萄糖的摄取和利用

正确答案：E。增加外周组织对葡萄糖的摄取和利用